下列有关椎动脉的叙述，哪项正确？
A. 经枕骨大孔入颅腔
B. 与小脑腹侧相邻
C. 走行于延髓背侧
D. 起自颈内动脉
E. 直接参与构成大脑动脉环

正确答案：A。经枕骨大孔入颅腔

解析：椎动脉起自锁骨下动脉（D错），向上穿第6至第1颈椎横突孔，经枕骨大孔进入颅腔（A对），在脑桥与延髓交界处的腹侧面（C错）。大脑动脉环由两侧大脑前动脉起始段、两侧颈内动脉末段、两侧大脑后动脉借前、后交通动脉共同组成（E错）。